患者，女性，35岁，某大学教师，3个月前因出国问题与领导争吵，而后逐渐表现出情绪低落、兴趣减退，对未来悲观失望，认为领导和同事都疏远她，常有怨天尤人的表现；能主动求医，接触良好。最合适的干预办法是
A. 门诊精神科治疗
B. 精神病院住院治疗
C. 门诊心理治疗
D. 门诊心理咨询
E. 家庭或社会心理治疗

正确答案：D。门诊心理咨询